某传染病的最短潜伏期为8天，最长潜伏期为22天，平均潜伏期为14天，症状期为21天，恢复期为30天。该病的检疫期限为
A. 8天
B. 22天
C. 14天
D. 21天
E. 30天

正确答案：B。22天